甲药品生产企业经批准可以生产第二类精神药品（口服剂型）、生物制品（注射剂），心血管类药品（注射剂和片剂），中药注射液和中药提取物的部分品种，乙药品生产企业持有与甲药品生产企业相同品种的《药品GMP》证书。甲药品生产企业可以委托乙药品生产企业生产的品种是
A. 生物制品（注射剂型）
B. 第二类精神药品（口服剂型）
C. 心血管类药品（注射剂和片剂）
D. 中药注射液和中药提取物

正确答案：C。心血管类药品（注射剂和片剂）

解析：本题考查药品委托生产品种。麻醉药品、精神药品、药品类易制毒化学品及其复方制剂、医疗用毒性药品、生物制品、多组分生化药品、中药注射剂、原料药和中药提取物不得委托（C对）。